验证药物与载体材料是否形成固体分散物的方法有
A. 红外光谱法
B. 热分析法
C. 溶解度及溶出速率法
D. 核磁共振法
E. X射线衍射法

正确答案：A、B、C、D、E。红外光谱法；热分析法；溶解度及溶出速率法；核磁共振法；X射线衍射法

解析：本题考查固体分散物的验证方法。固体分散物的验证主要包括如下方法：①红外光谱法（A对）；②热分析法（B对）；③溶解度与溶出速率法（C对）；④核磁共振法（D对）；⑤X-射线衍射法（E对）。